盐酸肾上腺素的杂质是
A. 游离水杨酸
B. 对氨基苯甲酸
C. 酮体
D. 罂粟酸
E. 多环芳烃

正确答案：C。酮体

解析：本题考查盐酸肾上腺素的特殊杂质。肾上腺素、盐酸异丙肾上腺素、重酒石酸去甲肾上腺素、盐酸去氧肾上腺素和盐酸甲氧明等苯乙胺类拟肾上腺素药物，其生产过程均存在酮体氢化还原制备工艺。若氢化过程不完全，易引入酮体（C对）杂质，影响药品质量。